参与Ⅱ型超敏反应的免疫球蛋白（Ig）是
A. IgM/IgD
B. IgM/IgG
C. IgA/IgE
D. IgM/IgA
E. IgE/IgD

正确答案：B。IgM/IgG